ABO抗原引起
A. Ⅰ型超敏反应
B. Ⅱ型超敏反应
C. Ⅲ型超敏反应
D. Ⅳ型超敏反应
E. 以上均不是

正确答案：B。Ⅱ型超敏反应

解析：ABO抗原可引起因血型不合所造成的溶血反应，供血者红细胞表面的血型抗原与受血者血清中的天然抗体结合后激活补体使红细胞溶解引起溶血反应，属于Ⅱ型超敏反应（B对）。接触变应原如花粉，虫螨等常引起Ⅰ型超敏反应（A错），链球菌感染后常引起Ⅲ型超敏反应（C错），胞内寄生物感染，如结核杆菌感染，常引起Ⅳ型超敏反应（D错）。